男婴，3天。黄疸速度加重2天，足月儿，母乳喂养。母亲血型为O型、Rh阳性，父亲血型为AB型、Rh阳性，实验室检查：TBil289μmol/L。为确认最有效的检查是
A. 血培养
B. 肝功能
C. 改良直接抗人球蛋白实验
D. 血型
E. 血涂片查红细胞形态

正确答案：C。改良直接抗人球蛋白实验

解析：本例患儿黄疸加重2天，母亲血型为O型，基因型记为ii，父亲血型为AB型，基因型记为AB，本患儿可能基因型为Ai或Bi，在分娩过程中，易发生ABO溶血，为确认最有效的检查是改良直接抗人球蛋白实验（C对）。血培养（A错）常用于败血症确诊。肝功能（B错）常用于检查肝部疾病。血型（D错）不能用于确诊本病，只能证实有血型不合存在。血涂片查红细胞形态（E错）常用于造血系统疾病检查。